组织糖尿病患者交流用药经验属于
A. 个例示范法
B. 座谈讨论法
C. 媒介传播法
D. 咨询答疑法
E. 专题讲座法

正确答案：B。座谈讨论法